男性，27岁。腹泻半天，呕吐3次。腹泻为淘米水样，半天已10余次，无腹痛，感口渴、乏力，粪检：WBC（2~5）个/HP。该腹泻的主要发生机制是
A. 渗出性腹泻
B. 渗透性腹泻
C. 分泌性腹泻
D. 吸收不良性腹泻
E. 肠动力增强性腹泻

正确答案：C。分泌性腹泻